患者女，42岁，反复低热，腰痛3年，多次尿培养有大肠杆菌，诊断考虑为
A. 急性尿道炎
B. 急性膀胱炎
C. 急性肾炎
D. 慢性肾盂肾炎
E. 急性肾盂肾炎

正确答案：D。慢性肾盂肾炎

解析：慢性肾盂肾炎的病人半数以上有急性肾盂肾炎病史，可间断出现尿频、排尿不适、腰酸痛等，部分患者有不同程度的低热以及肾小管功能受损表现（夜尿增多、低比重尿等）。病情持续可进展为慢性肾衰竭，根据患者症状，可以诊断为慢性肾盂肾炎（D对）。急性尿道炎（A错）、急性膀胱炎（B错）、急性肾炎（C错）、急性肾盂肾炎（E错）表现为高热、寒战、头痛、周身酸痛、恶心、呕吐，尿频、尿急、尿痛，下腹疼痛，腰痛，肾区叩击痛，均发病急骤，持续时间短。